“想象”这种心理活动属于
A. 情感过程
B. 意志过程
C. 意识过程
D. 个性特征
E. 认识过程

正确答案：E。认识过程